常伴AFP升高的卵巢肿瘤
A. 浆液性癌
B. 无性细胞瘤
C. 胚胎瘤
D. 卵黄囊瘤
E. 未成熟畸胎瘤

正确答案：D。卵黄囊瘤

解析：卵巢内胚窦瘤（D对）的特异性肿瘤标志物是AFP，对其诊断及病情监测有重要意义。CA125是诊断卵巢浆液性癌（A错）价值最大的肿瘤标志物。